在肘前区，肘横纹上，肱二头肌肌腱尺侧缘凹陷中的腧穴是
A. 少海
B. 小海
C. 曲泽
D. 曲池
E. 尺泽

正确答案：C。曲泽

解析：在肘前区，肘横纹上，肱二头肌肌腱尺侧缘凹陷中的腧穴是曲泽（C对）。少海位于肘前区，横平肘横纹，肱骨内上髁前缘（A错）。小海位于肘后区，尺骨鹰嘴与肱骨内上髁之间凹陷中（B错）。曲池位于肘区，在尺泽与肱骨外上髁连线中点凹陷处（D错）。尺泽位于肘区，肘横纹上，肱二头肌健桡侧缘凹陷中（E错）。